我国健康教育面临的挑战为
A. 新型传染病的增加
B. 营养不良病的增加
C. 普通传染病的流行
D. 职业病的增加
E. 新型传染病和普通传染病并存

正确答案：E。新型传染病和普通传染病并存